女，31岁。2年前因胃出血行胃大部切除术。近1年半来头晕，乏力，面色逐渐苍白，平时月经量稍多。检查：Hb76g/L，RBC3.1×10¹²/L，WBC5.3×10⁹/L，网织红细胞0.015。在进行体格检查时，不可能出现的体征是
A. 皮肤干燥，毛发干燥易脱落
B. 行走不稳，深感觉减退
C. 口腔炎，舌乳头萎缩
D. 指甲变脆，变平或匙状甲
E. 心尖部收缩期吹风样杂音

正确答案：B。行走不稳，深感觉减退

解析：患者育龄女性，既往胃大部切除术史，月经量稍多（缺铁性贫血的病因），近一年出现头晕、乏力、面色逐渐苍白（贫血表现），检查：Hb76g/L（成年女性正常值Hb＞110g/L），RBC3.1×10¹²/L（成年女性正常值3.5～5.0×10¹²/L）提示贫血，网织红细胞0.015（正常值0.005～0.015）符合缺铁性贫血网织红细胞变化，故最可能的诊断为缺铁性贫血，缺铁性贫血的组织缺铁表现包括毛发干枯、脱落（A错）；口腔炎、舌炎、舌乳头萎缩（C错）；指甲缺乏光泽，脆薄易裂、匙状甲（D错）；缺铁性贫血由于组织缺氧，可刺激心率加快、心搏增强，长此以往，会导致左心室代偿性肥大，二尖瓣相对性关闭不全，可在心尖部闻及收缩期吹风样杂音（五版内科学P588）（E错）；巨幼细胞性贫血（P545）常有行走不稳，深感觉减退（B对）症状。